使血药浓度-时间曲线上出现双峰现象的原因通常是
A. 酶诱导作用
B. 肾小球滤过
C. 酶抑制作用
D. 首关效应
E. 肠-肝循环

正确答案：E。肠-肝循环

解析：本题考查双峰现象出现的原因。某些药物会因肠-肝循环（E对）在血药浓度-时间曲线上出现第二个峰，即产生双峰现象。